颌面部检查的内容包括
A. 面部皮肤颜色、营养状态
B. 颌面部外形的对称性
C. 颌面各部分之间的比例关系
D. 侧面轮廓的面型
E. 以上都对

正确答案：E。以上都对

解析：颌面部检查的内容是通过视诊仔细观察患者颌面部的外形及其他特征。面部皮肤颜色、营养状态。颌面部外形的对称性。颌面各部分之间比例关系是否协调对称，有无颌面部畸形，面下1/3的高度是否协调。口唇的外形，笑线的高低，上下前牙位置与口唇的关系。侧面轮廓是直面型、凸面型还是凹面型，颅、面、颌、牙各部分的前后位置和大小比例是否正常，有无颌骨前突或后缩等异常情况。掌握“修复学临床检查”知识点。